在牙胚发育的时期，首先形成的部分为
A. 牙乳头
B. 牙囊
C. 成釉器
D. 牙板
E. 牙釉质

正确答案：C。成釉器

解析：在牙胚发育时期，成釉器首先形成。掌握“牙胚的发生及分化”知识点。